慢性胃炎脾胃虚弱证的治法是
A. 温中散寒，和胃止痛
B. 健脾益气，温中和胃
C. 益气养胃
D. 理气和胃
E. 疏肝健胃，醒脾化浊

正确答案：B。健脾益气，温中和胃

解析：慢性胃炎脾胃虚弱证的病机为病程日久，脾胃虚弱，脾胃功能减弱，故治法为健脾益气，温中和胃（B对），宜选健脾益气温中的四君子汤加减，气虚甚者，加用黄芪；虚寒甚者可合用理中丸，或改用黄芪建中汤。温中散寒，和胃止痛（A错），是寒邪内阻证的治法。益气养胃（C错）是脾胃气虚证的治法。理气和胃（D错）是肝胃不和证的治法。疏肝健胃，醒脾化浊（E错），是肝郁横脾，脾虚湿盛的治法。